肌醇三磷酸（IP3）可以
A. 促进甘油二酯生成
B. 使细胞膜钙泵活性增强
C. 促进内质网中Ca2+释放至胞液
D. 促进Ca2+与CaM结合
E. 促进Ca2+与蛋白激酶C结合

正确答案：C。促进内质网中Ca2+释放至胞液

解析：IP3作为第二信使，打开细胞内部膜结构上的Ca2+通道，促进内质网中Ca2+的释放，使胞液Ca2+的浓度增高，并引起一系列的生理效应。掌握“各信号分子及转导机制”知识点。